社会医学基本理论的主要特点是
A. 创新性、科学性、实用性和政策性
B. 创造性、预见性、实用性和政策性
C. 创新性、预见性、实践性和政策性
D. 开创性、可行性、实用性和科学性

正确答案：C。创新性、预见性、实践性和政策性

解析：本题考查社会医学基本理论的主要特点。社会医学基本理论的主要特点是：1.创新性：源于医学思维与实践的创新，具有创新性和革命性；2.预见性：是对医学本质的看法，对卫生事业的发展有一定的预见性；3.实践性：源于医疗卫生实践，指导卫生实践，并在实践中不断丰富和发展；4.政策性（C对ABD错）：是对医学发展规律的认识。